细菌的遗传物质是DNA，其载体包括两种物质，一种染色体，另一种是所谓“染色体外遗传物质”，系指
A. 转移因子
B. 转座子
C. 噬菌体
D. 质粒
E. 核糖核蛋白体

正确答案：D。质粒